位于背侧丘脑前下方的是
A. 背侧丘脑
B. 上丘脑
C. 内、外侧膝状体
D. 下丘脑
E. 底丘脑

正确答案：D。下丘脑

解析：下丘脑（D对）位于背侧丘脑的前下方。上丘脑（B错）居第三脑室顶后部的周围，为背侧丘脑与中脑顶盖前区相移行的部分。底丘脑（E错）是间脑和中脑之间的过渡区，位于背侧丘脑与内囊下部之间。后丘脑居于背侧丘脑的后下方，中脑顶盖的上方，包括内侧膝状和外侧膝状体（C错）。